欲了解水源周围污染情况，应进行
A. 毒理实验
B. 水质检验
C. 水质卫生特征测定
D. 流行病学调查
E. 水源环境卫生调查

正确答案：E。水源环境卫生调查

解析：本题考查水源环境卫生调查。欲了解水源周围污染情况，应进行水源环境卫生调查（E对ABCD错）。水源环境卫生调查可以检测水源周围的污染物，包括有机物、无机物、重金属、微生物等，可以检测水源周围的污染程度，以及污染物的来源，从而了解水源周围污染情况。此外，水源环境卫生调查还可以检测水源周围的水质卫生特征，以及水源周围的毒理特性，从而更好地了解水源周围污染情况。